女性，40岁。左乳房外上象限4cm×3cm肿块，距乳头距离5cm，可推动，但是病人双手叉腰时肿块活动度明显受限，左腋窝未扪及肿大淋巴结。该病人最佳的定性诊断方法是
A. 粗针穿刺活检
B. 钼靶X线摄片
C. 切取活检
D. 近红外线扫描
E. 细针穿刺细胞学检查

正确答案：E。细针穿刺细胞学检查

解析：40岁女性患者（乳腺癌高发人群），左乳房外上象限可推动肿物（大小4cm×3cm，距乳头5cm），双手叉腰时肿块活动度明显受限，左腋窝未扪及肿大淋巴结，为确定肿物性质，最佳诊断方式为活组织病理检查，目前常用空心针穿刺组织学检查，方法为检查者以左手拇、示指固定肿块，皮肤消毒后以空芯针（常用14G，直径1.95mm）直刺肿块，肿块位置较深时，可在超声引导下穿刺。细针穿刺细胞学检查也可用于肿瘤性质的判断（E对A错）。钼靶X线摄片（B错）常用于乳腺癌普查，用以检出肿块，但不能明确肿块性质。切取活检（C错）现已极少采用，已被术中冰冻活检或快速病理检查取代。近红外线扫描（D错）为显示乳腺肿块的检查，无法对肿块进行定性诊断。